女，20岁。吵架后突然倒在沙发上，全身抽搐。查体：面色苍白，呼吸急促，眼睑紧闭，眼球乱动，瞳孔对称，对光反射存在，双侧Babinski征未引出，常规脑电图未见异常。最可能的诊断是
A. 晕厥发作
B. 复杂部分性癫痫发作
C. 全身强直阵挛癫痫发作
D. 假性癫痫发作
E. 短暂性脑缺血发作

正确答案：D。假性癫痫发作

解析：青年女性患者，吵架后（有精神诱因存在）突然倒在沙发上，全身抽搐。查体：面色苍白，呼吸急促，眼睑紧闭，眼球乱动，瞳孔对称，对光反射存在，双侧Babinski征未引出常规脑电图未见异常（可排除癫痫的诊断）。最可能的诊断是假性癫痫发作（D对）（P309）。假性癫痫发作是一种非癫痫性的发作性疾病，是由心理障碍而非脑电紊乱引起的脑部功能异常引起，可有运动、感觉和意识模糊等类似癫痫发作症状。晕厥发作（A错）与短暂性脑缺血发作（E错）不会表现为全身抽搐症状，且发作较慢，不符合此患者情况。复杂部分性癫痫发作（B错）、全身强直阵挛癫痫发作（C错）脑电图会有相应的痫性放电。